X线表现为：肠管扩张，积气积液，立位或侧位水平摄片可见肠管扩张，呈阶梯状气液平应考虑的疾病是
A. 消化道穿孔
B. 消化道溃疡
C. 肠梗阻
D. 消化道肿瘤
E. 消化道结核

正确答案：C。肠梗阻

解析：肠梗阻典型X线表现为梗阻上段肠管扩张、积气、积液。立位或侧卧位水平位摄片可见肠管扩张，肠内有多数含气液平面，长短不一，高低不等，如阶梯状；仰卧位可见膨胀充气、盘曲排列的肠管（C对）。消化道穿孔主要 X线征象为膈下游离气体，表现为双侧膈下线条状或新月状透光影，边界清楚，上缘为光滑整齐的膈肌，下缘分别为肝、脾上缘（A错）。消化道溃疡可见龛影（B错）。消化道肿瘤气钡双重对比造影表现为∶腔内可见肿块、肠管狭窄、溃疡（D错）。消化道结核主要X线征象为：管腔向心性狭窄；粘膜存在、粗乱；充盈缺损，溃疡、窄道及瘘管形成（E错）。